患者，男，38岁。患急性子痈2天，恶寒发热，左侧睾丸肿大疼痛，疼痛引及子系(精索)，舌红苔黄腻，脉滑数。证属湿热下注，气血壅滞，经络阻隔为患。治宜清热解毒，利湿消肿，应首选
A. 透脓散
B. 滋阴除湿汤
C. 萆薢化毒汤
D. 龙胆泻肝汤
E. 枸橘汤加减

正确答案：E。枸橘汤加减

解析：该患者患急性子痈，证属湿热下注，宜清热解毒，利湿消肿，选项中枸橘汤功能疏泄厥阴，分利湿热，较之龙胆泻肝汤多了全枸橘、川楝子之品，止痛效力更加，故为最佳答案（E对）。透脓散可托里透脓，用于乳痈之热毒炽盛（A错）。滋阴除湿汤可养阴清热利湿，用于子痰之阴虚内热证（B错）。萆薢化毒汤可解毒利湿，用于烂疔之湿火炽盛（C错）。龙胆泻肝汤可清热利湿，但无消肿止痛之功，非最佳答案（D错）。